队列研究的最大优点是
A. 对较多的人进行较长时间的随访
B. 发生偏倚的机会少
C. 较直接地检验因素与疾病的因果关系
D. 研究的结果常能代表全人群

正确答案：C。较直接地检验因素与疾病的因果关系

解析：本题考查队列研究的优点。队列研究的优点为：①由于研究对象的暴露资料是在结局发生之前收集的，并且都是按照设计由研究者亲自观察得到的，所以资料完整可靠，信息偏倚相对较小；②可以直接获得暴露组和对照组人群的发病或死亡率，可直接计算出RR和AR等反映疾病危险强度的指标，可以充分而直接地分析暴露的病因作用；③由于病因发生在前，疾病发生在后，因果现象发生的时间顺序是合理的，加之偏倚较少，又可直接计算各项测量疾病危险强度的指标，故其检验病因假说的能力较强，一般可证实病因联系（C对ABD错）；④有助于了解人群疾病的自然史，有时还可能获得多种预期以外的疾病的结局资料，可分析一因与多种疾病的关系。